在每克或每毫升化妆品中不得检出的为
A. 真菌、痢疾杆菌、铜绿假单胞菌
B. 真菌、粪大肠菌群、溶血性链球菌
C. 溶血性链球菌、金黄色葡萄球菌、破伤风杆菌
D. 厌氧菌、金黄色葡萄球菌、粪大肠菌群
E. 粪大肠菌群、铜绿假单胞菌、金黄色葡萄球菌

正确答案：E。粪大肠菌群、铜绿假单胞菌、金黄色葡萄球菌